可降低天南星毒性的常用炮制方法是
A. 炒法
B. 炙法
C. 燀法
D. 提净法
E. 复制法

正确答案：E。复制法

解析：本题考查的是饮片炮制方法。可降低天南星毒性的常用炮制方法是复制法（E对）。复制法是将净选后的药物加入一种或数种辅料，按规定操作程序，反复炮制的方法。复制的主要目的：①降低或消除药物的毒性或刺激性，如半夏等。②改变药性，如天南星等。③增强疗效，如白附子等。④矫臭矫味，如紫河车等。炒法（A错）是将净制或切制过的药物，筛去灰屑，大小分档，置炒制容器内，加辅料或不加辅料，用不同火力加热，并不断翻动或转动使之达到一定程度的炮制方法。炒法目的是增强药效，缓和或改变药性，降低毒性或减少刺激，矫臭矫味，利于贮藏和制剂。炙法（B错）是将净选或切制后的药物，加入定量的液体辅料拌炒，使辅料逐渐渗入药物组织内部的炮制方法。药物吸入辅料经加热炒制后在性味、功效、作用趋向、归经和理化性质方面均能发生某些变化，起到降低毒性、抑制偏性、增强疗效、矫臭矫味、使有效成分易于溶出等作用，从而达到最大限度地发挥疗效的目的。燀法（C错）是将药物置沸水中浸煮短暂时间，取出，分离种皮的方法。燀制的主要目的：①在保存有效成分的前提下，除去非药用部分，如苦杏仁等。②分离不同药用部位，如白扁豆等。提净法（D错）：指某些矿物药，特别是一些可溶性无机盐类药物，经过溶解，过滤，除净杂质后，再进行重结晶，以进一步纯净药物的方法。提净的目的：①使药物纯净，提高疗效。②缓和药性。③降低毒性。